以关节活动弹响（骨摩擦音）为特征性体征的风湿病是
A. 类风湿关节炎
B. 强直性脊柱炎
C. 风湿热关节受累
D. 骨性关节炎
E. 痛风性关节炎

正确答案：D。骨性关节炎

解析：骨性关节炎以关节软骨变性损害为主，初起表现为局灶性软化，失去正常弹性，继而出现微小裂隙、粗糙、糜烂、溃疡，软骨大片脱落可致软骨下骨板裸露。软骨缺失及关节面不光整致关节活动时出现摩擦感及摩擦音（P857）。因此关节活动时粗糙的摩擦感是骨性关节炎（D对）特征性表现。类风湿性关节炎（A错）主要病理表现为关节内滑膜炎，软骨破坏较轻（P807），活动时不会出现摩擦音。强制性脊柱炎（B错）主要病理改变为附着点炎，较少伴发骨关节破坏，因此较少出现骨摩擦音，其最典型和常见表现为炎性腰背痛（P825）。风湿热关节受累（C错）以膝、踝、肘、腕、肩等大关节受累为主，局部可有红、肿、灼热、疼痛和压痛，发作后无变形遗留，关节无破坏，不会出现骨摩擦音（P805）。痛风性关节炎（E错）主要累及第一、二跖趾关节，局部可有红、肿、灼热、疼痛和压痛，无骨摩擦音。